判定化合物结构中是否具有共轭体系的常用方法
A. 紫外光谱法
B. 质谱法
C. 正相色谱法
D. 反相色谱法
E. 凝胶色谱法

正确答案：A。紫外光谱法

解析：本题考查中药有效成分的结构鉴定方法。判定化合物结构中是否具有共轭体系的常用方法紫外光谱法（A对）。紫外（UV）光谱的测定仅需要少量的纯样品，这对于中药化学成分的研究是非常有利的。一般来说，UV光谱主要提供化合物分子中共轭体系的结构信息，可据此判断共轭体系中取代基的种类、位置和数目。近年来，新的离子源不断出现，质谱（B错）在确定化合物分子量、元素组成和由裂解碎片检测官能团、辨认化合物类型、推导碳骨架等方面发挥着越来越重要的作用。分配色谱法有正相（C错）与反相（D错）色谱之分。在正相分配色谱法中，流动相的极性小于固定相的极性。凝胶色谱法（E错）：凝胶色谱法也称凝胶过滤法、凝胶渗透色谱、分子筛过滤或排阻色谱，是根据物质分子大小差别进行分离。